用于投射性测验的是
A. 明尼苏达多项人格调查表
B. 比奈智力测试
C. 卡特尔16PF测量
D. 主题统觉测验
E. 90项症状自评

正确答案：D。主题统觉测验